以下关于银汞合金的备洞要求，不恰当的说法是
A. 需做成盒形洞
B. 有一定固定形状
C. 洞缘曲线圆钝
D. 点线角锐利
E. 去除无基釉

正确答案：D。点线角锐利

解析：点线角应圆钝。掌握“牙体充填材料之银汞合金”知识点。